影响味觉的因素是
A. 年龄因素
B. 食物温度
C. 精神心理因素
D. 内分泌和内环境的变化
E. 以上均包括

正确答案：E。以上均包括

解析：食物温度，味觉的敏感性在食物20～30℃时最强；精神心理因素，如精神异常、情绪变化、心理紧张，均可影响味觉；年龄增长（如50岁左右），味蕾萎缩而变性，数量减少，导致味觉灵敏度下降，常见的表现为老年人嗜偏咸食物。全身健康因素：①全身性疾患；②胃肠道疾病；③内分泌和内环境的变化，如更年期或妊娠期；④遗传性因素，如遗传性味盲，可致味觉障碍，有的仅致某一种基本味觉障碍。掌握“口腔感觉”知识点。